患者腹大按之不坚，胁下胀满或疼痛，小便短少，纳食减少，食后作胀，嗳气，舌苔白腻，脉弦。诊断为
A. 水湿浸渍型水肿
B. 寒湿困脾型臌胀
C. 气滞湿阻型臌胀
D. 肝郁气滞型臌胀
E. 肝气郁结型胁痛

正确答案：C。气滞湿阻型臌胀

解析：肝气郁滞，脾运不健，湿热中阻，浊气充塞，故见腹大按之不坚；肝失条达，络气痹阻，故见胁下胀满或疼痛；气滞湿阻，水道不利故见小便短少；气滞中阻，脾胃运化失职，纳食减少，食后作胀，嗳气；舌苔白腻，脉弦，均为气滞湿阻型臌胀的特点（C对）。水湿浸渍型水肿（A错）的特点为全身水肿，按之没指，伴有胸闷腹胀，身重困倦，纳呆，泛恶，小便短少。寒湿困脾型臌胀（B错）的特点为腹大胀满，按之如囊裹水，甚则颜面微浮，下肢浮肿，怯寒懒动，精神困倦，脘腹痞胀，得热则舒，食少便溏，小便短少。肝郁气滞型臌胀（D错）的特点为腹大胀满，按之软而不坚，两胁胀痛不舒，随情志变化病情加重。肝气郁结型胁痛（E错）的症状为胁痛难忍，悲哀恼怒，郁伤肝气，筋脉拘急，腰脚重滞。